关于成釉器发育的特点以下说法错误的是
A. 胚胎第五周，开始出现马蹄形的原发性上皮带
B. 牙胚发育中，成釉器的发育经历三个时期
C. 牙胚发育中，成釉器首先形成
D. 在成釉器的帽状期，细胞分化为四层
E. 成釉器帽状期出现外釉上皮，内釉上皮和星网状层

正确答案：D。在成釉器的帽状期，细胞分化为四层

解析：成釉器来自于牙板。在胚胎第5周，在未来的牙槽突区，出现马蹄形上皮带，称为原发性上皮带，进而发育成成釉器。在牙胚发育中，成釉器首先形成，可分为三个时期：蕾状期、帽状期、钟状期。帽状期成釉器的细胞分化为三层：外釉上皮、内釉上皮、星网状层。掌握“牙胚的发生及分化”知识点。